健康促进的重要策略之一是
A. 初级卫生保健
B. 社区卫生服务
C. 健康教育
D. 爱国卫生运动
E. 卫生监督

正确答案：C。健康教育